男性，52岁，突起头痛、视物模糊、失语，血压28.0/17.3kPa(210/130mmHg)。降压药物应首选
A. 硝普钠
B. 速尿
C. 心得安
D. 异搏定
E. 巯甲丙脯酸

正确答案：A。硝普钠

解析：硝普钠使用：①用于高血压急症，如高血压危象、高血压脑病、恶性高血压、嗜铬细胞瘤手术前后阵发性高血压等的紧急降血压，也用于外科麻醉期间进行控制性降压；②用于急性心力衰竭，包括急性肺水肿。宜用于急性心肌梗塞或瓣膜（二尖瓣或主动脉瓣）关闭不全时的急性心力衰竭。掌握“原发性高血压”知识点。